在某些情况下，能刺激机体产生免疫应答的自身物质是
A. 自身抗原
B. 同种异型抗原
C. 超抗原
D. 独特型抗原
E. 异嗜性抗原

正确答案：A。自身抗原